压片前，干颗粒的处理工序通常有
A. 整粒
B. 加崩解剂
C. 加润滑剂
D. 加润湿剂
E. 加挥发油或挥发性药物

正确答案：A、B、C、E。整粒；加崩解剂；加润滑剂；加挥发油或挥发性药物

解析：本题考查干颗粒压片前的处理。压片前，干颗粒的处理工序通常有整粒（A对）、加崩解剂（B对）、加润滑剂（C对）、加挥发油或挥发性药物（E对）。干颗粒压片前的处理：（1）整粒，整粒的目的是将干颗粒过筛，使其中的团块状物、条状物分散成均匀的颗粒。（2）配粒又称总混，是将处方中的挥发性成分、其他液体成分及崩解剂、润滑剂等加入颗粒中混匀的操作。润湿剂（D错）：用疏水性药物配制混悬液时，必须加人润湿剂，使药物能被水润湿。